绝大多数淋病传播方式是
A. 通过污染的衣物间接传播
B. 通过性交经黏膜传播
C. 医源性传播
D. 经公共浴池传播
E. 经消毒不彻底的检查器械传播

正确答案：B。通过性交经黏膜传播